人端坐、头直立时与水平面平行的是
A. 眶耳平面
B. 鼻翼耳屏线
C. （牙合）平面
D. Balkwill角
E. Bonwill角

正确答案：A。眶耳平面

解析：眶耳平面：由眶下缘最低点到外耳孔上缘连成的平面称眶耳平面。当人端坐、头直立时，此平面与水平面平行。掌握“（牙合）分类及临床意义与面部结构”知识点。